下列关于慢性肾衰竭概念说法正确的是
A. 肾单位不可逆破坏
B. 代谢废物潴留;
C. 水、电解质代谢紊乱
D. 存在慢性肾疾病
E. 以上多种因素共同作用

正确答案：E。以上多种因素共同作用

解析：各种慢性肾脏疾病（D对）引起肾单位慢性进行性、不可逆性破坏（A对），以致残存的肾单位不足以充分排除代谢废物和维持内环境恒定，导致水、电解质和酸碱平衡紊乱（C对），代谢产物在体内积聚（B对），以及肾内分泌功能障碍，并伴有一系列临床症状的病理过程，被称为慢性肾衰竭。因此，慢性肾衰竭是以上多种因素共同作用（E对）所引起。